《处方药与非处方药流通管理暂行规定》要求，对医师处方进行审核，签字的人员必须是
A. 药店经理
B. 值班经理
C. 店员
D. 药士
E. 执业药师或药师

正确答案：E。执业药师或药师